环境卫生标准的制订原则不包括
A. 对主观感觉无不良影响
B. 保障居民不发生急性中毒
C. 保证居民不发生慢性危害
D. 不需要考虑经济因素
E. 选用最敏感原则

正确答案：D。不需要考虑经济因素

解析：本题考查环境卫生标准的制订原则。制定环境卫生标准是以剂量-反应关系为依据的，一般用“最高容许度”来表示。环境卫生标准的制订原则包括：1.保障居民不发生急性中毒（B对）或慢性危害（C对）；2.对主观感觉无不良影响（A对）；3.对人体健康无间接影响；4.选用最敏感指标（E对）；5.经济合理和技术可行（D错，为本题正确答案）。